某男，56岁。口渴引饮，能食易饥，大便溏薄，精神不振，四肢乏力；舌淡，苔薄白而干，脉细弱无力。空腹血糖为10.2mmol/L，糖化血红蛋白为8%。诊断为消渴。四诊合参，辨析其证候是
A. 阴虚燥热
B. 脾胃气虚
C. 气阴两虚
D. 肾阴亏虚
E. 阴阳两虚

正确答案：B。脾胃气虚

解析：本题考查消渴之脾胃气虚证的症状。四诊合参，中医辩证为消渴之脾胃气虚证（B对）。消渴之脾胃气虚证【症状】口渴引饮，能食与便溏并见，或饮食减少，精神不振，四肢乏力。舌淡，苔薄白而干，脉细弱无力。消渴之阴虚燥热（A错）证【症状】烦渴引饮，消谷善饥，小便频数而多，尿浑而黄，形体消瘦。舌红，苔薄黄，脉滑数。消渴之气阴两虚（C错）证【症状】口渴引饮，咽干口燥，多食善饥，倦怠乏力，便溏溲多，或形体消瘦。舌质淡红，苔白而干，脉弱。消渴之肾阴亏虚（D错）证【症状】尿频量多，浊如膏脂，腰酸膝软，头晕耳鸣，多梦遗精，乏力，皮肤干燥。舌红少苔，脉细数。消渴之阴阳两虚（E错）证【症状】小便频数，甚则饮一溲一，咽干舌燥，面容憔悴，耳轮干枯，腰膝酸软，畏寒肢冷。舌淡，苔白少津，脉沉细无力。